与HMG-CoA还原酶的亲和力高出HMG-CoA数千倍，对该酶产生竞争性的抑制作用，使Ch合成受阻的药物是
A. 钙离子拮抗剂
B. 贝特类药物
C. 噻嗪类药物
D. 酰胺类药物
E. 他汀类药物

正确答案：E。他汀类药物

解析：他汀类与HMG-CoA的化学结构相似，且和HMG-CoA还原酶的亲和力高出HMG-CoA数千倍，对该酶产生竞争性的抑制作用，使Ch合成受阻。掌握“抗动脉粥样硬化药”知识点。